治疗淋病湿热毒蕴证的主方是
A. 龙胆泻肝汤
B. 知柏地黄丸
C. 萆薢渗湿汤
D. 萆薢化毒汤
E. 清营汤

正确答案：A。龙胆泻肝汤

解析：淋病是因湿热秽浊之气由下焦前阴窍口入侵，阻滞于膀胱及肝经，局部气血运行不畅，湿热熏蒸，精败肉腐，气化失司而成，龙胆泻肝汤尤善祛除肝经湿热（A对）。知柏地黄丸具有滋阴清热之功，适于阴虚毒恋的淋病、生殖器疱疹（B错）。萆薢渗湿汤具有清热利湿之功，适于湿热蕴肤的药毒、湿毒蕴阻的银屑病（C错）。萆薢化毒汤具有利湿化浊，清热解毒之功，适于湿热下注的尖锐湿疣（D错）。清营汤具有清营解毒，透热养阴之功效，适于热毒入营的药毒（E错）。